前庭韧带
A. 指弹性圆锥的游离缘
B. 指方形膜的游离下缘
C. 中间的裂隙称声门裂
D. 附着在甲状软骨上角与杓状软骨之间
E. 其上缘附着甲状软骨板的上缘

正确答案：B。指方形膜的游离下缘

解析：前庭韧带指方形膜的游离下缘（A错B对）。声门裂是两侧声襞与杓状软骨底和声带突之间的裂隙（C错）。